胎黄是指
A. 新生儿黄疸
B. 新生儿生理性黄疸
C. 新生儿病理性黄疸
D. 胎儿黄疸
E. 母亲与新生儿同患黄疸

正确答案：A。新生儿黄疸

解析：西医学称胎黄为新生儿黄疸（A对）。新生儿生理性黄疸只是其中的一部分（B错）。新生儿病理性黄疸是另外一部分，包括血清胆红素增高的一系列疾病，如胆道畸形、胆汁淤阻、肝细胞性黄疸等（C错）。胎儿还在母体，较少研究其是否黄疸（D错）。母亲黄疸不属于新生儿黄疸范畴，故不称为胎黄（E错）。